某社区实施一项高血压综合防治项目，在项目“执行计划一年后，项目地区70％高血压患者家庭学会自测血压”，属于健康教育计划的
A. 总体目标
B. 教育目标
C. 健康目标
D. 行为目标
E. 过程目标

正确答案：D。行为目标